急性持续性腹痛，阵发性加剧并伴休克情况下，最可能是
A. 输尿管结石肾绞痛
B. 单纯性机械性肠梗阻
C. 急性阑尾炎
D. 绞窄性肠梗阻
E. 胆道蛔虫病

正确答案：D。绞窄性肠梗阻

解析：急性持续性腹痛，阵发性加剧并伴休克情况下，最可能的疾病是绞窄性肠梗阻（D对）。绞窄性肠梗阻时由于梗阻的肠段急性缺血、坏死，患者多表现为持续性腹痛，当肠内容物通过梗阻肠段时可加重腹痛；肠壁血运障碍，毛细血管通透性增加，大量渗出液渗入肠腔和腹腔，使血容量下降，严重者可出现休克。输尿管结石肾绞痛（P558）（A错）表现为阵发性腰部或上腹部疼痛，疼痛剧烈难忍，可沿输尿管行径放射至同侧腹股沟。单纯性机械性肠梗阻（B错）的腹痛呈阵发性绞痛，由于肠管无血运障碍，体液丢失少，一般不出现休克。急性阑尾炎（C错）的腹痛发作始于上腹，逐渐移向脐部，后转移并局限在右下腹，即转移性右下腹疼痛。胆道蛔虫病（E错）常表现为突发的剑突下钻顶样剧烈绞痛，阵发性加剧，可放射至右肩胛或背部，腹痛可骤然缓解，间歇期可全无症状。